我国将吗啡列为严格管制药品，原因是长期使用可能产生
A. 免疫抑制
B. 嗜睡
C. 呼吸抑制
D. 中枢抑制
E. 药物依赖性

正确答案：E。药物依赖性

解析：本题考查吗啡。长期使用阿片类镇痛药可致药物依赖性（E对），突然停药可出现戒断症状。阿片类镇痛药已列入《麻醉药品和精神药品管理条例》，严格管理限制使用。